哮证多见
A. 呼吸不畅，胸闷气短
B. 呼吸有力，声高气粗
C. 呼吸困难，短促急迫
D. 呼吸困难，喉中有声
E. 呼多吸少，气不得续

正确答案：D。呼吸困难，喉中有声

解析：本题考查的是呼吸异常变化的临床意义。哮证多见呼吸困难，喉中有声（D对）。呼吸异常变化的临床意义：（1）气微与气粗：气微，指呼吸微弱，多是肺肾之气不足，属于内伤虚损；气粗，指呼吸有力，声高气粗（B错），多是热邪内盛、气道不利，属于实热证。（2）哮与喘：哮，是喘气时喉中有哮鸣声的现象。喘，指呼吸困难、短促急迫（C错），甚则鼻翼扇动，或张口抬肩，不能平卧的现象。喘有虚实之分。若喘息气粗、声高息涌、唯以呼出为快的，属实喘，多因肺有实邪、气机不利所致；若喘声低微息短、呼多吸少、气不得续（E错）的，属虚喘，乃肺肾气虚、出纳无力之故。（3）少气与叹息：少气，指呼吸微弱，气少不足以息的现象，多因气虚所致。叹息（古称太息），指胸中郁闷不舒，发出长叹声音的现象，多因情志抑郁、肝失疏泄所致。症状为呼吸不畅，胸闷气短（A错）的疾病，2022年考试指南未明确说明。